对于消化道平滑肌的描述，不正确的是
A. 兴奋性较高
B. 有节律性
C. 对电刺激不敏感
D. 富有延展性
E. 具有紧张性

正确答案：A。兴奋性较高